关于子宫韧带的解剖，正确的是
A. 圆韧带起于子宫角，止于腹股沟
B. 阔韧带富于肌纤维，与子宫体肌纤维相连
C. 卵巢固有韧带使子宫倾向后方
D. 主韧带横行于宫颈两侧和骨盆侧壁之间
E. 子宫动静脉从阔韧带上部穿过

正确答案：D。主韧带横行于宫颈两侧和骨盆侧壁之间

解析：子宫韧带（P7）共有4对，包括圆韧带、阔韧带、主韧带和宫骶韧带。圆韧带（A错）起自宫角的前面、输卵管近端的稍下方，经腹股沟管止于大阴唇前端。阔韧带（B错）由覆盖子宫前后壁的腹膜自子宫侧缘向两侧延伸达盆壁而成，其内有丰富的血管、神经、淋巴管及大量疏松结缔组织，子宫动静脉（E错）和输尿管在其基底部穿过。主韧带又称子宫颈横韧带，横行于子宫颈两侧和骨盆侧壁之间（D对），是固定子宫颈位置、防止子宫下垂的主要结构。宫骶韧带起自子宫体和子宫颈交界处后面的上侧方，向两侧绕过直肠到达底2、3骶椎前面的筋膜，向后向上牵引子宫颈，维持子宫前倾位置。卵巢固有韧带（P8）（C错）不属于子宫韧带，是固定卵巢的韧带。